足三阴经在足内踝上8寸以下的分布是
A. 厥阴在前，太阴在中，少阴在后
B. 厥阴在前，少阴在中，太阴在后
C. 少阴在前，太阴在中，厥阴在后
D. 太阴在前，厥阴在中，少阴在后
E. 太阴在前，少阴在中，厥阴在后

正确答案：A。厥阴在前，太阴在中，少阴在后

解析：足三阴经在足内踝上8寸以下由前到后为：足厥阴肝经、足太阴脾经、足少阴肾经（A对）。在足内踝上8寸以上由前到后为：足太阴脾经、足厥阴肝经、足少阴肾经。